尿毒症患者伴高钾血症降血钾最有效的疗法是
A. 口服碳酸钙
B. 必需氨基酸疗法
C. 补充1，25-（OH）₂-D3
D. 促红细胞生成素
E. 血液透析治疗

正确答案：E。血液透析治疗

解析：尿毒症患者伴高钾血症降血钾最有效的方法是血液透析治疗（E对）。血液透析可清除患者体内的尿毒症毒素，并可纠正高钾血症和代谢性酸中毒，从而降低血钾浓度。必需氨基酸疗法（八版内科学P530）（B错）主要用于肾功能不全且需要限制蛋白质摄入的患者，但并不可用于降血钾。补充1，25-(OH）₂-D3（P525）（C错）可通过肠壁增加磷的吸收，并通过肾小管增加磷的再吸收，但对血钾浓度没有影响。促红细胞生成素（P524）（D错）主要用于慢性肾功能不全引发的肾性贫血。